2岁患儿，持续发热半月余，烦躁、易怒，日渐加重伴嗜睡，抽搐2次，脑脊液检查结果：外观微混，细胞数300×109/L，多核22%，单核78%。生化：蛋白92g/L，氯化物95mmol/L，糖1.8mmol/L。根据病史及脑脊液结果，最可能的诊断是
A. 结核性脑膜炎
B. 化脓性脑膜炎
C. 感染中毒性脑病
D. 真菌性脑膜炎
E. 病毒性脑膜炎

正确答案：A。结核性脑膜炎